刺激小肠粘膜释放胆囊收缩素的作用最强的物质是
A. 盐酸
B. 蛋白质分解产物
C. 脂酸钠
D. 脂肪
E. 糖类

正确答案：B。蛋白质分解产物

解析：缩胆囊素是小肠上部的Ι细胞分泌的，具有刺激胰液分泌和胆囊收缩，增强小肠和大肠运动，抑制胃排空的作用。引起缩胆囊素释放的因素由强至弱的顺序为蛋白质分解产物（B对）、脂酸钠（C错）、盐酸（A错）、脂肪（D错）。糖类没有刺激作用（E错）。